女，68岁。高血压病史5年，药物治疗后血压波动于140～170/50～80mmHg。既往糖尿病史。该患者的收缩压控制目标应低于
A. 140mmHg
B. 130mmHg
C. 125mmHg
D. 120mmHg
E. 110mmHg

正确答案：B。130mmHg

解析：本题考查糖尿病的血压控制目标。高血压一般主张血压控制目标值应＜140/90mmHg（A错）。糖尿病、慢性肾脏病、心力衰竭或病情稳定的冠心病合并高血压患者，血压控制目标值＜130/80mmHg（B对）（P252-P253）。如尿蛋白排泄率＞1g/24h，应控制在＜125/75mmHg（C错）。